某患者，发热39℃，脾肝肿大，颈部淋巴结可触及，血液WBC增多，异型淋巴细胞可检出，印象诊断是传染性单核细胞增多症，引起该病病原体是
A. 腺病毒
B. 丙型肝炎病毒
C. 风疹病毒
D. 巨细胞病毒
E. EB病毒

正确答案：E。EB病毒

解析：EBV在人群中感染非常普遍。中国3～5岁儿童的EBV抗体阳性率达90%以上。幼儿受染后多数无明显症状，青春期发生原发感染，约50%出现传染性单核细胞增多症。病毒主要通过唾液传播，病毒可从口咽部排出达数周至数月。原发感染后，机体产生特异性中和抗体和细胞免疫，虽能防止外源性再感染，但不能完全清除潜伏在细胞内的EBV。在体内潜伏的病毒与宿主保持相对平衡状态。少量EBV在口咽部继续产生低滴度的增殖性感染。这种持续感染的状态可保持终身。由EBV感染引起或与EBV感染有关的疾病主要有4种：①传染性单核细胞增多症；②非洲儿童恶性淋巴瘤即Burkitt淋巴瘤；③鼻咽癌；④淋巴增生性疾病，如AIDS患者极易机会性感染EBV，导致弥漫性多克隆淋巴瘤等并可致死。掌握“疱疹病毒”知识点。